胆总管结石梗阻后最典型的临床表现是
A. Whipple三联征
B. Charcot三联征
C. Grey-Turner征
D. Murphy征阳性
E. Cullen征

正确答案：B。Charcot三联征

解析：胆总管结石梗阻后最典型的临床表现是Charcot三联征（B对），即腹痛、寒战高热、黄疸。Whipple三联征：空腹或运动后出现低血糖症状；发作时血糖低于2.8mmol/L；口服或静脉注射葡萄糖后，症状可立即消失。Whipple三联征（A错）为胰岛素瘤的典型表现。重症胰腺炎时，胰腺的出血会经腹膜后途径进入皮下，在腰部、季肋部、下腹部皮肤出现大片青紫色淤斑，称Grey-Turner征（C错），出现在脐周，称为Cullen征（E错）。医师用左手掌平放于患者右胸下部，以拇指指腹勾压于右肋下胆囊点处，嘱患者缓慢深吸气，在吸气的过程中发炎的胆囊下移时碰到用力按压的拇指，引起胆囊触痛，如因剧烈腹痛而致吸气终止，称Murphy征（D错）阳性，见于急性胆囊炎尚未突出于肋下缘者。